两组生存资料的Log-rank检验的无效假设是
A. 两组的生存率相同
B. 两组的中位生存时间相同
C. 两条总体生存率曲线相同
D. 两个总体的平均生存时间相同

正确答案：C。两条总体生存率曲线相同

解析：本题考查Log-rank检验的无效假设。两组生存资料的Log-rank检验的无效假设是两条总体生存率曲线相同（C对ABD错）。